患者关节肿痛，疼痛剧烈，入夜尤甚，壮热烦渴，舌红少津，脉弦数。其证型是
A. 风湿热痹
B. 湿热蕴蒸
C. 化火伤津
D. 阴虚有热
E. 风寒湿痹

正确答案：C。化火伤津

解析：患者关节肿痛，疼痛剧烈，为湿热化火之象；入夜尤甚，壮热烦渴，舌红少津，为伤津的表现，脉弦数；综上可知为化火伤津之证（C对）。风湿热痹多表现为游走性关节疼痛，局部灼热红肿，痛不可触，常伴有发热，恶风，口渴等全身症状（A错）。湿热蕴蒸多表现为关节红肿疼痛，头痛胀如裹，身热不扬，口渴不欲饮，多汗，舌苔黄腻，脉濡数（B错）。阴虚有热多见于痹症日久，关节屈伸不利，肌肉瘦削，骨蒸劳热，心烦口渴等（D错）。风寒湿痹多分为肢体关节酸痛，游走不定的行痹；肢体关节疼痛较剧，痛有定处的痛痹和肢体关节重着、酸痛或有肿胀，手足沉重肌肤麻木不仁的着痹（E错）。